常山的功效是
A. 引去湿热
B. 止痢截疟
C. 涌吐痰饮
D. 止血止泻
E. 收湿敛疮

正确答案：C。涌吐痰饮

解析：本题考查常山的功效。常山的功效是涌吐痰饮（C对）。常山【功效】涌吐痰饮，截疟。瓜蒂【功效】内服涌吐热痰、宿食；外用研末吹鼻，引去湿热（A错）。鸦胆子【功效】清热解毒，燥湿杀虫，止痢截疟（B错），腐蚀赘疣。白矾【功效】外用解毒杀虫，燥湿止痒；内服止血止泻（D错），清热消痰。石膏【功效】生用：清热泻火，除烦止渴；煅用：收湿敛疮（E错），生肌止血。